未取得放射诊疗许可从事放射诊疗工作情节严重的应
A. 以5千元以下的罚款
B. 承担刑事责任
C. 以3千元以下的罚款
D. 吊销《医疗机构执业许可证》
E. 给予警告、责令限期改正

正确答案：D。吊销《医疗机构执业许可证》

解析：医疗机构有下列情形之一的，由县级以上卫生行政部门给予警告、责令限期改正，并可以根据情节处以3千元以下的罚款；情节严重的，吊销其《医疗机构执业许可证》：①未取得放射诊疗许可从事放射诊疗工作的；②未办理诊疗科目登记或者未按照规定进行校验的；③未经批准擅自变更放射诊疗项目或者超出批准范围从事放射诊疗工作的。掌握“放射诊疗的防护与法律责任”知识点。